兴奋性突触后电位是由于突触后膜提高了对下列哪些离子的通透性引起的
A. Cl⁻，Na⁺，尤其是Cl⁻
B. Na⁺，K⁺，尤其是Na⁺
C. K⁺，Na⁺，尤其是K⁺
D. Ca²⁺，Na⁺，尤其是Ca²⁺
E. Ca²⁺，Na⁺，尤其是Na⁺

正确答案：B。Na⁺，K⁺，尤其是Na⁺

解析：兴奋性突触后电位的形成是兴奋性递质作用于突触后膜的相应受体使后膜对Na⁺和K⁺的通透性增大，且Na⁺内流大于K⁺外流，导致后膜出现局部去极化（B对）。